某研究者收集了两种不同方法治疗某病的随访资料，现欲比较两法生存率曲线是否有差别，可选择
A. 线性回归
B. X²检验
C. u检验
D. t检验
E. log-rank检验

正确答案：E。log-rank检验